正确叙述椎间盘的是
A. 共有24个
B. 由髓核和纤维环构成
C. 在中胸部最厚
D. 髓核易向前外方突出
E. 椎间盘突出症的常见部位在胸部

正确答案：B。由髓核和纤维环构成

解析：椎间盘是位于相邻两椎体间的纤维软骨盘，由纤维环和髓核组成（B对），成人共有23个椎间盘（A错）。人体各部椎间盘以腰部最厚，其次是颈部，中胸部最薄（C错）。正是由于腰椎较大，腰椎间盘承受的压力最大，所以椎间盘突出症常见部位在腰部（E错），由于椎间盘后部是椎管或椎间孔，所以纤维环破裂时易向后外侧（D错）突出。